属副交感神经节前纤维的是
A. 白交通支
B. 灰交通支
C. 鼓索
D. 脊神经后支
E. 眼神经

正确答案：C。鼓索

解析：白、灰交通支（AB错）由交感神经节前纤维构成。鼓索（C对）内含节前纤维。脊神经后支（D错）为混合性神经支。眼神经（E错）仅含躯体感觉纤维。